何首乌蒸制后，致泻作用减弱的原因是
A. 卵磷酸含量降低
B. 总氨基酸含量降低
C. 结合型蒽醌含量降低
D. 游离生物碱含量降低
E. 二苯乙烯苷含量降低

正确答案：C。结合型蒽醌含量降低

解析：本题考查的是何首乌的炮制原理。何首乌蒸制后，致泻作用减弱的原因是结合型蒽醌含量降低（C对）。何首乌蒸制过程中，外表颜色加深，总蒽醌、结合蒽醌含量随着蒸制时间延长而减少，游离蒽醌开始增加（D错），使致泻作用减弱。制首乌的磷脂类成分和糖的含量增加（A错），使补益作用更加突出。二苯乙烯苷（E错）含量随蒸制时间增加而降低。